下列关于乳糖操纵子的叙述，哪项是正确的
A. 属于可诱导型调控
B. 属于可阻遏型调控
C. 结构基因产物抑制分解代谢
D. 结构基因产物与分解代谢无关
E. 受代谢终产物抑制

正确答案：A。属于可诱导型调控

解析：乳糖操纵子属于可诱导型调控（A对）；色氨酸操纵子属于可阻遏型调控（B错）。乳糖操纵子的结构基因产物为β-半乳糖苷酶、通透酶和乙酰基转移酶，它们均是催化乳糖分解代谢的酶，对分解代谢有促进作用（CD错）。生成的代谢终产物（即半乳糖）作为一种诱导剂分子结合阻遏蛋白（E错），使蛋白质构象变化，导致阻遏蛋白与O序列解离、发生转录，使β-半乳糖苷酶分子增加可达1000倍，从而加速反应的进行。